某单位一周内发生伤寒病人33例，死患率15%，该病例属于
A. 流行
B. 大流行
C. 散发
D. 暴发
E. 局部流行

正确答案：D。暴发

解析：考察疾病的流行强度的相关概念。流行（P8）（A错）是指某病的发病率显著超过该病历年发病水平。大流行（P8）（B错）是指某病发病率显著超过该病历年发病水平，疾病蔓延迅速。涉及地区广，在短时间内跨省界、国界、洲界形成世界性流行。这两个概念都是针对大范围，且与往年发病率比较，题干均未提到。散发（P8）（C错）指发病率呈历年一般水平，各病例间在发病时间和地点上无明显联系，表现为散在发生。暴发（D对）是指在一个局部地区或集体单位中，短时间内突然发生很多症状相同的病人，这些人多有相同的传染源或传播途径。题干中提到“某单位”“一周内”符合暴发定义中的“集体单位”“短时间”。局部流行（E错）不符合流行病学流行强度描述。